修复前患牙根分叉病变严重，则应采取
A. 拔除
B. 正畸治疗
C. 牙槽骨成形术
D. 临床牙冠延长
E. 咬合调整与选磨

正确答案：C。牙槽骨成形术

解析：本题考查修复前准备。修复前患牙根分叉病变严重，则应采取牙槽骨成形术（C对）。多根牙根分叉病变较轻时，通过龈上洁治，龈下刮治、牙龈切除术或牙龈成形术以及保持良好的口腔卫生等措施，能够有效地控制其病变且预后较好。 如果根分叉病变严重，则需另外采取牙-骨成形术、牙根切断术或分根术，尽可能将患牙保留。